以下哪种细胞因子是Th2细胞产生的
A. IL-3
B. IFN-γ
C. TNF-α
D. IL-4
E. IL-1

正确答案：D。IL-4

解析：本题考查Th2细胞产生的细胞因子。Th2细胞产生的细胞因子是IL-4（D对）。IL-3（A错）是主要是由CD4+T细胞分泌的；、IFN-γ（B错）是由Th1分泌的；TNF-α（C错）是由Th17分泌的；IL-1（E错）由单核细胞、内皮细胞、成纤维细胞和其他类型细胞在应答感染时产生的。